在新中国成立初期，我国就制定了卫生工作的四大方针，以后又相继制定了一系列卫生政策和措施，目前我国人民的健康水平已接近发达国家水平。此成就反映了影响健康的因素是
A. 经济发展
B. 社会制度
C. 医疗服务
D. 社会人口
E. 文化因素

正确答案：B。社会制度